自牙颈部的牙骨质，越过牙槽突外侧皮层骨膜，进入牙槽突和前庭肌和口底的纤维束是
A. 龈牙组
B. 牙槽龈组
C. 环形组
D. 牙骨膜组
E. 越隔组

正确答案：D。牙骨膜组

解析：牙骨膜组自牙颈部的牙骨质，越过牙槽突外侧皮层骨膜，进入牙槽突和前庭肌和口底。掌握“牙龈”知识点。